女性，54岁，双侧腮腺肿大10余年。镜下见涎腺内大量淋巴组织增生，破坏腺泡，腺导管增生形成上皮岛，病变中无纤维修复现象。最可能的病理诊断是
A. 慢性涎腺炎
B. 坏死性涎腺化生
C. 涎腺症
D. 舍格伦综合征
E. 涎腺结核

正确答案：D。舍格伦综合征

解析：舍格伦综合征早期淋巴细胞浸润于腺泡之间，进而使腺泡破坏。密集的淋巴细胞形成滤泡。病变严重时，小叶内腺泡全部消失，而为淋巴细胞、组织细胞所取代，腺小叶内缺乏纤维结缔组织修复。小叶内导管上皮增生，形成实质性上皮团片即上皮肌上皮岛。而慢性涎腺炎可能有淋巴细胞浸润，但纤维性修复现象较明显，也无上皮岛样改变；涎腺结核时可有淋巴细胞浸润，但还有上皮样细胞和多核巨细胞的结节。涎腺症和坏死性涎腺化生无大量的淋巴细胞浸润。掌握“坏死性唾液腺化生与舍格伦综合征”知识点。